前牙3/4冠邻沟位于邻面的
A. 唇1/3
B. 唇1/3与中1/3交界
C. 中1/3
D. 中1/3与舌1/3交界
E. 舌1/3

正确答案：B。唇1/3与中1/3交界

解析：本题考查前牙3/4冠邻沟的位置。邻沟（邻轴沟）的位置一般位于唇颊轴线角与颊侧接触点之间，在前牙即唇1/3与中1/3交界（B对），不要破坏邻接点的唇侧部分，保证尽量不暴露金属，美观，又能获得足够的固位力。位于邻面的唇1/3（A错）会显露金属，破坏唇侧的邻接点。位于邻面的中1/3（C错）、中1/3与舌1/3交界（D错）、舌1/3（E错）无法起到抵抗舌向脱位的作用，那么邻沟的制备就没有意义了。